功能温补气血的成药有
A. 人参养荣丸
B. 十全大补丸
C. 八珍颗粒
D. 人参固本丸
E. 当归补血丸

正确答案：A、B。人参养荣丸；十全大补丸

解析：本题考查的是人参养荣丸与十全大补丸的功能。功能温补气血的成药有人参养荣丸（A对）与十全大补丸（B对）。人参养荣丸：【功能】温补气血。十全大补丸：【功能】温补气血。八珍颗粒（C错）：【功能】补气益血。人参固本丸（D错）：【功能】滋阴益气，固本培元。当归补血丸（E错）：【功能】补养气血。